24岁女性，停经58天，13天前行人工流产吸宫术。术后持续阴道流血。为明确诊断，首先应选用的辅助检查方法是
A. 腹腔镜检查
B. 子宫镜检查
C. B型超声检查
D. hCG测定
E. 血常规检查

正确答案：C。B型超声检查

解析：患者为青年女性，停经后行人工流产吸宫术，术后持续阴道流血（手术后阴道流血时间长，血量多或流血停止后再现多量流血，应考虑为吸宫不全），初步考虑的诊断是吸宫不全。血或尿hCG检测和B型超声检查均有助于诊断，但B型超声（C对）较血或尿hCG（D错）检测简便易行，无创，安全有效，是人工流产吸宫不全的首选辅助检查方法。腹腔镜检查（P446）（A错）主要用于盆腹腔病变的诊断和治疗，是异位妊娠诊断的金标准。子宫镜（P445）（B错）主要用于宫腔内膜病变的诊断。血常规检查（E错）对人流术吸宫不全不具有特异性。